某公司数人在某家甜品店食用雪糕后感染痢疾，同时疾病预防控制中心从雪糕中分离到痢疾杆菌，从而确定雪糕是
A. 传染源
B. 传播途径
C. 传播媒介
D. 传播方式
E. 传播因素

正确答案：E。传播因素

解析：本题考查传播因素。传播因素指水、空气、食物、土壤等无生命物质，从雪糕中分离出痢疾杆菌，从而确定雪糕是传播因素（E对ABCD错）。